依据《素问·宣明五气篇》理论，久坐易伤及的是
A. 气
B. 血
C. 肉
D. 精
E. 筋

正确答案：C。肉

解析：《素问·宣明五气》说“久视伤血，久卧伤气，久坐伤肉（C对），久立伤骨，久行伤筋，是谓五劳所伤”。久坐伤肉是由于长时间的久坐，缺乏活动，周身气血运行缓慢，可使肌肉松弛无力，所以伤及肉。过度卧床，易使肺吸入的新鲜空气缺乏，肺的机能变弱，而肺主一身之气，所以久卧伤气（A错）。久视伤血是由于“肝开窍于目”，且肝受血而能视，所以伤及血（B错）。房劳过度可伤及精，因房劳过度伤及肾，肾藏精，为封藏之本，但不属于五老所伤（D错）。久行伤筋是由于久行能使膝关节过度疲倦，而膝为筋之府，所以久行可伤及筋（E错）。